以下外国药典的缩写是欧洲药典的是
A. JP
B. USP
C. BP
D. ChP
E. Ph.Eur.

正确答案：E。Ph.Eur.

解析：本题考查药典。以下外国药典的缩写是欧洲药典的是Ph.Eur.（E对）。《欧洲药典》的全称为European Pharmacopoeia (缩写为 Ph. Eur.EP) ，由欧洲药品质量理事会 (EDQM) 编辑出版。JP（A错）是《日本药局方》的缩写。USP（B错）是《美国药典》的缩写。BP（C错）是《英国药典》的缩写。ChP（D错）是《中国药典》的缩写。